常规抗休克措施应用后血压仍不理想的顽固性休克病人，必要时可试用哪种药物治疗
A. 低分子右旋糖苷
B. 酚妥拉明
C. 多巴酚丁胺
D. 西地兰
E. 糖皮质激素

正确答案：E。糖皮质激素

解析：糖皮质激素（E对）常用于严重、顽固性休克，特别是感染中毒性休克的治疗。大剂量糖皮质激素抗休克作用机制为：①抑制某些炎性因子的产生，减轻全身炎症反应综合征及组织损伤，使微循环血流动力学恢复正常，改善休克状态；②稳定溶酶体膜，减少心肌抑制因子的形成；③扩张痉挛收缩的血管和兴奋心脏、加强心脏收缩力；④提高机体对细菌内毒素的耐受力。低分子右旋糖酐（A错）为血浆代用品，可扩充血容量；酚妥拉明（B错）属血管扩张剂，可使血压进一步下降；多巴酚丁胺（C错）为血管收缩剂；西地兰（D错）为强心药，它们均不能有效治疗顽固性休克。